根据《麻醉药品和精神药品管理条例》，下列叙述正确的有
A. 邮寄麻醉药品和精神药品，寄件人应当提交本企业上级管理部门出具的准予邮寄证明
B. 运输第一类精神药品的承运人在运输过程中应当携带运输证明副本
C. 第二类精神药品经营企业应当在药品库房中设置专区储存第二类精神药品
D. 医疗机构抢救病人急需麻醉药品而本医疗机构无法提供时，可以从定点批发企业借用
E. 麻醉药品和第一类精神药品不得零售

正确答案：B、C、D、E。运输第一类精神药品的承运人在运输过程中应当携带运输证明副本；第二类精神药品经营企业应当在药品库房中设置专区储存第二类精神药品；医疗机构抢救病人急需麻醉药品而本医疗机构无法提供时，可以从定点批发企业借用；麻醉药品和第一类精神药品不得零售

解析：本题考查麻醉药品和精神药品管理。根据《麻醉药品和精神药品管理条例》，下列叙述正确的有运输第一类精神药品的承运人在运输过程中应当携带运输证明副本（B对）；第二类精神药品经营企业应当在药品库房中设置专区储存第二类精神药品（C对）；医疗机构抢救病人急需麻醉药品而本医疗机构无法提供时，可以从定点批发企业借用（D对）；麻醉药品和第一类精神药品不得零售（E对）。托运单位办理麻醉药品和第一类精神药品运输手续时，应当将运输证明副本交付承运单位。承运单位应当查验、收存运输证明副本，并检查货物包装。没有运输证明或者货物包装不符合规定的，承运单位不得承运。运输证明副本应随货同行以备查验，在运输途中承运单位必须妥善保管运输证明副本，不得遗失。货物到达后，承运单位应将运输证明副本递交收货单位。收货单位应在收到货物后1个月内将运输证明副本交还发货单位。第二类精神药品经营企业，应当在药品库房中设立独立的专库或者专柜储存第二类精神药品，并建立专用账册，实行专人管理。专用账册的保存期限应当自药品有效期期满之日起不少于5年。医疗机构抢救患者急需麻醉药品和第一类精神药品而本医疗机构无法提供时，可以从其他医疗机构或者定点批发企业紧急借用；抢救工作结束后，应当及时将借用情况报所在地设区的市级药品监督管理部门和卫生主管部门备案。麻醉药品和第一类精神药品不得零售。除经批准的药品零售连锁企业外，其他药品零售企业不得从事第二类精神药品零售活动。麻醉药品和精神药品可以邮寄。邮寄麻醉药品和精神药品，寄件人应当提交所在地设区的市级药品监督管理部门出具的准予邮寄证明（A错）。